男，70岁，软弱无力，进食减少，口渴、多尿2周，近2天嗜睡。急诊检查：BP70/50mmHg，神志朦胧，皮肤干燥失水，呼吸34次/分，心率108次/分，尿糖（++++），尿酮（±）。既往无糖尿病史。最主要的治疗措施是
A. 抗感染
B. 肾上腺皮质激素
C. 口服降血糖药
D. 小剂量胰岛素及补液
E. 补充碱性药物

正确答案：D。小剂量胰岛素及补液

解析：老年男性患者，既往无糖尿病病史（高渗性非酮症糖尿病昏迷的好发人群），近2周出现口渴、多尿、软弱无力、进食减少，近2天嗜睡，查体出现血压下降与脱水表现、意识障碍（高渗性非酮症糖尿病昏迷典型临床表现），化验尿糖强阳性，尿酮体弱阳性，应考虑诊断为高渗性非酮症糖尿病昏迷。本例患者已出现血压下降、严重脱水状态，应首先补充丢失水分、扩充血容量，降低血糖（D对）。感染为本病的常见诱因，抗感染（A错）治疗亦十分重要，但应在补充血容量后开始，只有在有效组织灌注改善、恢复后，药物才能发挥有效作用，且本例未提及有感染诱因。糖皮质激素（B错）治疗不用于高渗高血糖综合征。患者神志不清，故不宜口服降血糖药（C错）。高渗高血糖状态一般无明显酸中毒，故无需补碱（E错）。